地西泮过量中毒的特效拮抗剂是
A. 纳洛酮
B. 氟西泮
C. 利多卡因
D. 苯妥英钠
E. 氟马西尼

正确答案：E。氟马西尼

解析：苯二氮䓬类药物静脉注射速度过快可导致呼吸和循环抑制，严重者可致呼吸和心跳停止，可用苯二氮草受体拮抗剂氟马西尼抢救（E对）。